固定子宫的位置不包括
A. 子宫的韧带
B. 盆隔
C. 尿生殖隔
D. 膀胱充盈度
E. 阴道

正确答案：D。膀胱充盈度

解析：子宫主要靠子宫的韧带（A对）、盆隔（B对）、尿生殖隔（C对）的托持和阴道（E对）以及周围结缔组织的牵拉等作用维持正常位置，膀胱充盈度不能固定子宫的位置（D错，为本题正确答案）。